关于腮腺的描述，正确的是
A. 仅位于咬肌表面
B. 腮腺管开口于平对上颌第二磨牙牙冠相对的颊粘膜处
C. 腮腺管在颧弓下二横指处可以摸到
D. 由面神经司腮腺的分泌
E. 以上都不对

正确答案：B。腮腺管开口于平对上颌第二磨牙牙冠相对的颊粘膜处

解析：腮腺前至咬肌表面，深至下颌后窝(A错)，腮腺管开口于平对上颌第二磨牙牙冠相对的颊粘膜处(B对)，腮腺管在颧弓下一横指处可以摸到(C错)，由舌咽神经司腮腺的分泌(D错)。